在社会卫生状况评价指标中，复合型健康评价指标是
A. 发病率
B. 期望寿命
C. 孕产妇死亡率
D. 减寿人年数
E. 死因顺位

正确答案：D。减寿人年数